下列药物中能燥湿止带的是
A. 防风
B. 白芷
C. 羌活
D. 苍耳子
E. 藁本

正确答案：B。白芷

解析：白芷的功效解表散寒，祛风止痛，宣通鼻窍，燥湿止带，消肿排脓（B对）。防风（A错）的功效祛风解表，胜湿止痛，止痉。羌活（C错）的功效解表散寒，祛风除湿，止痛。苍耳子（D错）的功效散风寒，通鼻窍，祛风湿，止痛。藁本（E错）的功效祛风，散寒，除湿，止痛。